流行病学实验研究最常用的分析指标是
A. 发病率、流行率、有效率
B. 有效率、治愈率、保护率
C. 发病率、死亡率、有效率
D. 发病率、病死率、有效率

正确答案：B。有效率、治愈率、保护率

解析：本题考查实验流行病学的常用分析指标。实验流行病学常用指标包括评价治疗措施效果的主要指标和评价预防措施效果的主要指标。其中，评价治疗措施效果的主要指标包括有效率、治愈率和N年生存率；评价预防措施效果的主要指标包括保护率（B对ACD错）和效果指数。